苍术的组织结构中有
A. 油细胞
B. 油室
C. 油管
D. 树脂道
E. 乳汁管

正确答案：B。油室